行阑尾切除术时，寻找阑尾基底部最常用的方法是
A. 从腘窝寻找
B. 用手指探查阑尾尖部
C. 沿结肠带向回盲部寻找
D. 切开盲肠外侧腹膜寻找
E. 沿盲肠外侧寻找

正确答案：C。沿结肠带向回盲部寻找

解析：行阑尾切除术时，有以下5个技术要点：1.麻醉：硬脊膜外麻醉、静脉复合麻醉，也可采用局部浸润麻醉；2.切口选择：一般情况下宜采用右下腹麦氏切口或横切口；3.部分病人阑尾就在切口下，容易显露，沿结肠带向盲肠会集点追踪，即能找到阑尾（C对ABCD错）；4.处理阑尾系膜，用阑尾钳钳夹阑尾系膜，不要直接钳夹阑尾，将阑尾提起显露系膜；5.处理阑尾根部：在距盲肠0.5cm处用钳轻轻钳夹阑尾后用丝线或肠线结扎阑尾，再于结扎线远端0.5cm处切断阑尾，残端用碘酒、酒精涂擦处理。